关于紫杉醇的说法，错误的是
A. 紫杉醇是首次从美国西海岸的短叶红豆杉树皮中提取得到的一个具有紫杉烯环的二萜类化合物
B. 在其母核中的3，10位含有乙酰基
C. 紫杉醇的水溶性大，其注射剂通常加入聚氧乙烯蓖麻油等表面活性剂
D. 紫杉醇为广谱抗肿瘤药物
E. 紫杉醇属有丝分裂抑制剂或纺锤体毒素

正确答案：C。紫杉醇的水溶性大，其注射剂通常加入聚氧乙烯蓖麻油等表面活性剂

解析：本题考查紫杉醇。紫杉醇由于水溶性小（C错，为本题正确答案），其注射剂通常加入表面活性剂，如聚环氧化蓖麻油等助溶，常会引起血管舒张，血压降低及变态反应等副作用。紫杉醇是从美国西海岸的短叶红豆杉的树皮中提取得到的一个具有紫杉烯环的二萜类化合物（A对），其母核中的3，10位含有乙酰基（B对），为广谱抗肿瘤药物（D对），紫杉醇属有丝分裂抑制剂或纺锤体毒素（E对）。